下列细胞类型中不属于多形性腺瘤镜下肿瘤细胞类型的是
A. 腺上皮细胞
B. 肌上皮细胞
C. 泡沫细胞
D. 黏液样组织
E. 软骨样组织

正确答案：C。泡沫细胞

解析：本题考查多形性腺瘤。泡沫细胞（C错，为本题正确答案）不属于多形性腺瘤镜下肿瘤细胞类型，属于根尖周肉芽肿中的细胞成分。多形性腺瘤镜下细胞的类型多样，组织结构复杂，其基本结构为腺上皮（A对）、肌上皮（B对）、黏液、黏液样组织（D对）和软骨样组织（E对）五种。